硫脲类不良反应为
A. 过敏反应
B. 甲状腺肿及甲状腺功能减退
C. 消化道反应
D. 粒细胞缺乏症
E. 以上说法均正确

正确答案：E。以上说法均正确

解析：硫脲类不良反应①过敏反应：最常见，皮肤瘙痒、药疹，少数伴有发热，应密切观察，一般不需停药也可消失。②消化道反应：有厌食、呕吐、腹痛、腹泻等，罕见黄疸性肝炎。③粒细胞缺乏症：为最严重不良反应，应定期检查血象。罕见血小板减少症。④甲状腺肿及甲状腺功能减退：长期用药后，可反馈性增加促甲状腺激素分泌而引起腺体代偿性增生、腺体增大、充血，还可诱导甲状腺功能减退。掌握“硫脲类药物”知识点。